临床按颈动脉窦治疗阵发性室上性心动过速的直接作用是
A. 心交感神经冲动增多
B. 交感缩血管纤维冲动增多
C. 心迷走神经冲动增多
D. 窦神经冲动增多
E. 交感舒血管纤维冲动增多

正确答案：C。心迷走神经冲动增多

解析：临床上对于阵发性室上速的治疗可选取单侧按摩颈动脉窦，通过刺激颈动脉窦压力感受器，兴奋心迷走神经（C对），抑制交感神经（A错），使心率减慢，达到治疗室上速的目的。心交感缩血管纤维冲动增多（B错）是通过缩血管效应，使血压升高，对治疗室上速无效。窦神经冲动增多（D错）是压力感受器的传入神经冲动增多，但不是治疗阵发性室上速的直接原因。交感舒血管纤维冲动增多（E错）是导致血管舒张效应的降压反射，对阵发性室上速的治疗无关。